楔状缺损常发生于
A. 上前牙
B. 下前牙
C. 上下颌双尖牙
D. 上颌磨牙
E. 下颌磨牙

正确答案：C。上下颌双尖牙

解析：本题考查楔状缺损的好发牙位。楔状缺损多发生于口角区的双尖牙（C对）。而上颌前牙（A错）和下颌前牙（B错）均位于牙弓最前端，应力不易于集中于此，前牙颈部不突出，故楔状缺损不易发生于此。上颌磨牙（D错）和下颌磨牙（E错）位于牙弓后缘，咬合面积大，不易发生（牙合）力疲劳，楔状缺损发生率也比较低。